牙折断是拔牙术中常发生的并发症，其原因可能为
A. 钳喙安放时位置不正确夹住牙冠
B. 拔牙钳选择不当，钳喙不能紧贴于牙面
C. 牙冠有广泛龋坏、牙的脆性增加
D. 周围骨质过度致密，或与牙根固连
E. 以上都是

正确答案：E。以上都是

解析：本题考查牙拔除术并发症。牙折断是拔牙术中常发生的并发症。分析其原因，有下列几种：①钳喙安放时位置不正确，或未与牙长轴平行，或未夹住牙根而夹住牙冠（A对）；②拔牙钳选择不当，钳喙不能紧贴于牙面（B对）；③牙冠有广泛龋坏；④牙的脆性增加（C对）；⑤牙根外形变异；⑥周围骨质因各种原因而过度致密，或与牙根固连（D对）；⑦拔牙时用力不当，用力的方向错误或因使用暴力所致。因此，选E。